《执业药师注册证》的有效期为
A. 2年
B. 3年
C. 5年
D. 1年
E. 7年零8个月

正确答案：C。5年

解析：本题考查执业药师注册有效期。执业药师注册有效期为五年（C对）。持证者须在有效期满三十日前向所在地注册管理机构提出延续注册申请。超过期限，不办理延续注册手续的人员，其《执业药师注册证》自动失效，并不能再以执业药师身份执业。办理延续注册时，同时变更执业单位的，须提交新执业单位合法开业证明。